食管第三个狭窄大约相当于哪个胸椎水平
A. 第8胸椎
B. 第9胸椎
C. 第10胸椎
D. 第11胸椎
E. 第12胸椎

正确答案：C。第10胸椎

解析：食管的三个狭窄，第一个狭窄大约相当于第6颈椎体下缘水平，第二个狭窄大约相当于第4、5胸椎体之间水平，第三个狭窄大约相当于第10胸椎水平(C对)。